男，56岁。"流感"后出现高热、咳嗽、咳黄痰伴痰中带血。胸片示右下肺大片影，其内可见多个圆形透亮区，有液平。最可能感染
A. 金黄色葡萄球菌肺炎
B. 厌氧菌
C. 肺炎克雷伯杆菌
D. 肺炎链球菌
E. 肺炎支原体

正确答案：A。金黄色葡萄球菌肺炎

解析：该患者最可能感染的病原体是金黄色葡萄球菌（A对），患者胸部X线片示右下肺大片状影，其内可见多个圆形透亮区，即气液囊腔。厌氧菌（B错）感染多有吸入病史，X线检查多有脓胸、脓气胸的表现。肺炎克雷伯杆菌（C错）感染X线表现为蜂窝状脓肿及叶间隙下坠。肺炎链球菌（D错）感染X线表现为大片炎症浸润阴影或实变影，在实变阴影中可见支气管充气征，肋膈角可有少量胸腔积液。肺炎支原体（E错）感染X先表现为肺部多种形态的浸润影，呈节段性分布，以肺下野多见。